与观察性研究相比较，实验性研究最基本的特点是
A. 有可重复性
B. 有人为干预措施
C. 是前瞻性研究
D. 可行性较好

正确答案：B。有人为干预措施

解析：本题考查流行病学研究观察性研究和实验性研究的基本特点。观察性研究在研究实施中描述或分析人群中的某些现象，从中找出规律性的结论，包括描述性流行病学和分析性流行病学；实验流行病学属于实验性研究，即有人为给予的干预措施（B对ACDE错），并强调随机分配。因此，是否有人为给予的干预措施是观察性研究和实验性研究的根本区别。